属于5-羟色胺再摄取抑制的药品是
A. 雷尼替丁
B. 奥美拉唑
C. 阿米替林
D. 度洛西汀
E. 氟西汀

正确答案：E。氟西汀

解析：本题考查抗抑郁药。5-羟色胺再摄取抑制剂在临床上应用的有氟西汀（E对）、帕罗西汀、舍曲林等。雷尼替丁（A错）为H₂受体阻断剂。奥美拉唑（B错）为质子泵抑制剂。阿米替林（C错）为三环类抗抑郁药。度洛西汀（D错）为5-羟色胺和去甲肾上腺素再摄取抑制剂。